下列关于外科疾病致病因素的叙述，错误的是
A. 气血瘀滞，经络阻塞
B. 外感六淫邪毒
C. 感受特殊之毒
D. 外来伤害
E. 房室损伤

正确答案：A。气血瘀滞，经络阻塞

解析：六淫邪毒能直接或间接地侵害人体，导致各类外科疾病的发生，六淫致病因素只有在人体抗病能力低下时，才能成为发病的条件；但有时也可因六淫邪毒的毒力强盛，超过了人体正常的抗病能力而造成外科疾病的发生和发展（B对）。特殊之毒包括虫毒、蛇毒、疯犬毒、药毒、食物毒、疫毒；在外科疾病中，可因虫兽咬伤，感受特殊之毒而发病，如毒蛇咬伤、狂犬病；接触疫畜如牛、马、羊而感染疫毒的疫疔；因虫螫咬伤后引起的虫咬皮炎；某些人因禀赋不耐，接触生漆后而发漆疮，或服用某种食物后中毒（C对）。外来伤害：凡跌仆损伤、沸水、火焰、寒冷及金刃竹木创伤等一切理化因素都可直接伤害人体，引起局部气血凝滞，郁久化热，热盛（胜）肉腐，导致瘀血流注、水火烫伤、冻伤、外伤染毒等外伤性疾病；同时也可因外伤而再感受毒邪，发生破伤风或手足疔疮等；或因损伤后致脉络瘀阻，气血运行失常，筋脉失养而发生脱疽等（D对）。房室损伤：导致脏腑气血受损，阴阳失和，使正气亏损而发生疾病（E对）（A错，为本题正确答案）。